急性有机磷农药中毒在临床上主要表现为
A. 呼吸道分泌物增加、肺水肿、瞳孔缩小
B. 全身紧束感、胸部压迫感、肌束震颤
C. 消化系统症状、眼睛的症状、呼吸道症状
D. 毒覃碱样症状、中枢神经系统症状、烟碱样症状
E. 呼吸肌麻痹、抽搐、昏迷

正确答案：D。毒覃碱样症状、中枢神经系统症状、烟碱样症状